深龋的临床表现是
A. 遇冷、热和化学刺激时疼痛较轻微
B. 龋洞形成，遇冷、热和化学刺激时疼痛，有时有自发痛
C. 可有放散痛，疼痛无法定位
D. 龋洞形成，遇冷、热和化学刺激时疼痛，刺激去除后症状即刻消失
E. 龋洞形成，遇冷、热和化学刺激时疼痛，刺激去除后疼痛持续较长时间

正确答案：D。龋洞形成，遇冷、热和化学刺激时疼痛，刺激去除后症状即刻消失

解析：本题考查深龋的临床表现。龋病进展到牙本质深层时为深龋，临床上可见很深的龋洞，遇冷、热或化学刺激可产生酸痛感觉，刺激去除后症状立即消失（D对A错），但深龋无自发性疼痛（B错）。放散痛、自发痛、疼痛无法定位为急性牙髓炎的表现（C错）。刺激去除后疼痛持续较长时间为不可复性牙髓炎的表现（E错）。